可防止髁突向外侧脱位的是
A. 颞下颌韧带
B. 翼下颌韧带
C. 蝶下颌韧带
D. 茎突下颌韧带
E. 茎突舌骨韧带

正确答案：A。颞下颌韧带

解析：颞下颌韧带，组成韧带的纤维均起于颞骨关节结节的外侧面，分为浅、深两层，浅层斜向后下，附着于髁突颈的外侧面；深层水平向后，附着于髁突外极和关节盘的后部。可防止髁突向外侧脱位。掌握“颞下颌关节的解剖特点”知识点。